按照《药品不良反应监测管理办法（试行）》，药品生产经营企业和医疗预防保健机构一经发现可疑的药品不良反应，需
A. 进行详细记录
B. 进行调查
C. 回收销毁药品
D. 按规定报告
E. 通知相关购销单位

正确答案：A、B、D。进行详细记录；进行调查；按规定报告

解析：本题考查不良反应。按照《药品不良反应监测管理办法（试行）》，药品生产经营企业和医疗预防保健机构一经发现可疑的药品不良反应，需：进行详细记录（A对）、进行调查（B对）、按规定报告（D对）。药品生产、经营企业和医疗机构应当主动收集药品不良反应，获知或者发现药品不良反应后应当详细记录、分析和处理，填写《药品不良反应/事件报告表》并报告。药品生产、经营企业和医疗机构获知或者发现药品群体不良事件后，应当立即通过电话或者传真等方式报所在地的县级药品监督管理部门、卫生行政部门和药品不良反应监测机构，必要时可以越级报告；同时填写《药品群体不良事件基本信息表》，对每一病例还应当及时填写《药品不良反应/事件报告表》，通过国家药品不良反应监测信息网络报告。